颈内动脉系统短暂性脑缺血发作的症状可有
A. 阵发性眩晕
B. 复视
C. 交叉性瘫痪
D. 吞咽困难
E. 运动性失语

正确答案：E。运动性失语

解析：颈内动脉主要分支有：眼动脉、后交通动脉、脉络膜前动脉、大脑前动脉以及大脑中动脉，供应大脑半球前2/3和部分间脑。颈内动脉系统短暂性脑缺血（TIA）的症状表现为颈内动脉系统支配区的缺血相关症状，可以出现运动性失语（E对）、眼动脉交叉瘫等表现。椎-基底动脉供应大脑后半球后1/3及部分间脑、脑干和小脑。阵发性眩晕（A错）、复视（B错）、交叉性瘫痪（C错）和吞咽困难（D错）均见于椎-基底动脉系统TIA。